2016年A地区新诊断出患有肺癌的男性的数量/2016年7月1日A地区估计的居住男性人口数
A. 发病率
B. 患病率
C. 死亡率
D. 病死率
E. 罹患率

正确答案：A。发病率

解析：本题考查发病率。发病率（A对BCDE错）是指一定期间内，一定范围人群中某病新发生病例出现的频率。其分子是一定时期内某人群中某病新病例数，分母是同期该人群暴露人口数。